某男，35岁。因肝胆湿热而导致头晕目赤，耳鸣，耳肿疼痛，胁痛口苦，尿赤涩痛，宜选用的成药是
A. 黄连上清丸
B. 一清颗粒
C. 牛黄解毒丸
D. 龙胆泻肝丸
E. 牛黄至宝丸

正确答案：D。龙胆泻肝丸

解析：本题考查的是龙胆泻肝丸的主治。因肝胆湿热而导致头晕目赤，耳鸣，耳肿疼痛，胁痛口苦，尿赤涩痛，宜选用的成药是龙胆泻肝丸（D对）。龙胆泻肝丸：【主治】肝胆湿热所致的头晕目赤、耳鸣耳聋、耳肿疼痛、胁痛口苦、尿赤涩痛、湿热带下。黄连上清丸（A错）：【主治】风热上攻、肺胃热盛所致的头晕目眩、暴发火眼、牙齿疼痛、口舌生疮、咽喉肿痛、耳痛耳鸣、大便秘结、小便短赤。一清颗粒（B错）：【主治】火毒血热所致的身热烦躁、目赤口疮、咽喉及牙龈肿痛、大便秘结、吐血、咯血、衄血、痔血；咽炎、扁桃体炎、牙龈炎见上述证候者。牛黄解毒丸（C错）：【主治】火热内盛所致的咽喉肿痛、牙龈肿痛、口舌生疮、目赤肿痛。牛黄至宝丸（E错）：【主治】胃肠积热所致的头痛眩晕、目赤耳鸣、口燥咽干、大便燥结。